不属于空气采集方法的是
A. 主动采集
B. 被动采集
C. 集气法
D. 检查表
E. 直读式检测仪

正确答案：D。检查表